真菌性败血症常见致病菌是
A. 金黄色葡萄球菌
B. 溶血性链球菌
C. 白色念珠菌
D. 变形杆菌
E. 拟杆菌

正确答案：C。白色念珠菌

解析：真菌性败血症常见致病菌是白色念珠菌（C对）。痈致病菌多为金黄色葡萄球菌（A错）。急性蜂窝组织炎的致病菌主要是溶血性链球菌（B错）。革兰染色阴性杆菌脓毒症常为大肠杆菌、绿脓杆菌、变形杆菌（D错）所引起。拟杆菌（E错）正常寄居于人和动物的肠道、口腔、上呼吸道和生殖道。